女性，32岁，不慎被机器将长发辫卷入造成大块头皮撕脱。最恰当的救治步骤是
A. 及时清创，复位缝合
B. 补液，抗感染
C. 止痛药物
D. 创口敷料覆盖加压包扎
E. 密切观察生命体征变化

正确答案：A。及时清创，复位缝合

解析：本题考查头皮撕脱伤的治疗。女性，32岁，不慎被机器将长发辫卷入造成大块头皮撕脱，应诊断为头皮撕脱伤。最恰当的救治步骤是及时清创，复位缝合（A对）。补液，抗感染（B错）、止痛药物（C错）、创口敷料覆盖加压包扎（D错）、密切观察生命体征变化（E错）均为创伤后的处理方法，但不属于最恰当的救治步骤。